下列选项中用于表示肌位的是
A. RCP
B. ICP
C. COP
D. MPP
E. MCP

正确答案：E。MCP

解析：由下颌姿势位通过主动肌肉收缩上提下颌达到初始的（牙合）接触时，下颌的位置为肌接触位，也称肌位（MCP）。掌握“下颌姿势位、三类颌位与前伸、侧方（牙合）颌位”知识点。